患者男性，46岁。乙型肝炎10年，现出现持续性肝区疼痛，消瘦，发热，食欲不振，乏力，营养不良应考虑
A. 慢性迁延性肝炎
B. 肝癌
C. 肝硬化
D. 肝脓肿
E. 肝血管瘤

正确答案：B。肝癌

解析：乙肝为促癌因素之一（患者有乙型肝炎病史10年）。肝癌临床表现有肝区疼痛，多呈持续性胀痛或钝痛（患者出现持续性肝区疼痛）。肝癌的全身表现为消瘦，发热，食欲不振，乏力，营养不良和恶病质（患者消瘦，发热，食欲不振，乏力，营养不良）（B对）。慢性迁延性肝炎患者轻度乏力、肝区痛、食欲差、腹胀等，亦可无明显症状。常伴有肝脏稍大，脾脏有时亦可肿大，但无进行性肿大。一般无黄疸，转氨酶持续或间歇升高，血浆白蛋白与球蛋白数值基本正常（A错）。肝硬化体征有肝病面容（脸色晦暗无华），可见多个蜘蛛痣，肝掌，黄疸，下肢水肿，肝脏质地偏硬，脾大，男性乳房发育（C错）。肝脓肿一般有明显的炎症表现，肿大的肝脏表面平滑无结节，触痛明显。白细胞计数增高，超声检查可探得肝内液性暗区（D错）。血管瘤增至5cm以上时，可出现下列症状：腹部包块、胃肠道症状、压迫症状、肝血管瘤破裂出血Kasabach-Merritt综合征（E错）。